以下关于金瓷冠基底冠的描述，哪项是错误的
A. 与预备体密合度好
B. 支持瓷层
C. 金瓷衔接处为刃状
D. 金瓷衔接处避开咬合区
E. 唇面为瓷层留出0．85～1．2mm间隙

正确答案：C。金瓷衔接处为刃状

解析：本题考查金属基底冠的设计。金瓷冠基底冠的金瓷衔接处应呈对接状形式，这种形式还可保证完成线部的瓷强度，防止遮色瓷从此暴露；若为刃状（C错，为本题的正确答案）时，易导致崩瓷。金瓷冠基底冠应与预备体密和度良好（A对），否则，金瓷冠有可能难以就位或金瓷冠与牙之间存在空隙，细菌侵入，造成继发龋。由于瓷承受拉伸、剪切的力量很弱，金属基底需保证一定的厚度，以支持瓷层（B对）帮助其承受咬合力，否则会导致瓷产生裂纹或皱折。金瓷冠的完成线处容易发生强度问题，因此，金瓷结合部应避免放在与对颌牙相接触，避开咬合区（D对），这种设计还有利于防止对颌牙磨损。金瓷冠牙体预备时，唇面需为瓷层留出0.85～1.2mm的间隙（E对），其中遮色瓷需0.2～0.3mm以及牙体部瓷需要0.7～1.0mm的厚度。